下列关于丁型肝炎病毒的说法错误的是
A. 是缺陷病毒
B. 只能伴随乙型肝炎病毒感染
C. 共用厕所可传染
D. 可产生慢性感染
E. 垂直传播

正确答案：C。共用厕所可传染